高血压性心脏病的体征是
A. 胸骨左缘第5肋间锁骨中线内搏动
B. 负性心尖搏动
C. 抬举性搏动
D. 剑突下搏动
E. 胸骨右缘第2肋间搏动

正确答案：E。胸骨右缘第2肋间搏动

解析：胸骨右缘第2肋间收缩期搏动，可见于高血压性心脏病（E 对）。正常心尖搏动一般位于第5肋间隙左锁骨中线内侧0.5～1.0cm处，搏动范围的直径为2.0～2.5cm（A错）。负性心尖搏动，见于粘连性心包炎心包与周围组织有广泛粘连时、右心室显著肥大者（B错）。循环系统疾病与抬举样搏动关系密切，如心室肥厚、室间隔缺损、二尖瓣关闭不全等；内分泌系统疾病，如甲状腺亢进也可诱发抬举样搏动。其他系统疾病，如血液病和传染病等，也会诱发抬举样搏动（C错）。剑突下搏动可见于右心室肥大或腹主动脉搏动（D错）。